肺炎球菌肺炎，常伴有
A. 咯铁锈色痰
B. 咯粉红色泡沫痰
C. 咯吐大量鲜血
D. 咯大量脓痰
E. 干咳无痰

正确答案：A。咯铁锈色痰

解析：肺炎球菌肺炎，常伴有咳铁锈色痰（A对）。咳粉红色泡沫痰见于急性左心衰（B错）。咳吐大量鲜血见于空洞性肺结核、支气管扩张、慢性肺脓肿等（C错）。咳大量脓痰见于支气管扩张、慢性肺脓肿等（D错）。干咳无痰见于急性咽喉炎、急性支气管炎初期、胸膜炎、肺结核等（E错）。